男性，41岁。上腹疼痛7小时。伴发热，体温38.5℃，频繁呕吐。查体发现上腹部肌紧张，压痛，无移动性浊音。血白细胞15×10⁹/L。X线检查：膈下未见游离气体。最可能的诊断是
A. 急性心肌梗死
B. 急性胰腺炎
C. 胆石症
D. 胃溃疡穿孔
E. 肠梗阻

正确答案：B。急性胰腺炎

解析：中年男性患者，上腹痛7小时、伴发热、频繁呕吐（急性胰腺炎常见的症状）。查体：上腹部肌紧张、压痛（腹膜刺激征）。血白细胞15×10⁹/L（正常为4～10×10⁹/L，提示有炎症）。X线检查：膈下未见游离气体（排除消化道穿孔）。综合患者的病史、查体、实验室检查，可初步诊断为急性胰腺炎（B对）。急性心肌梗死（P236）（A错）主要表现为发作性心前区疼痛，患者常有胸闷或濒死感，偶可表现为上腹痛，但不会出现压痛、肌紧张（腹膜刺激征）等体征。胆石症（九版外科学P439）（C错）主要表现为在饱餐、进食油腻食物后或睡眠中改变体位时右上腹阵发性或持续性绞痛，常放射至右肩背部。胃溃疡穿孔（九版外科学P340）（D错）X线检查可见膈下新月状游离气体影。肠梗阻（九版外科学P360）（E错）主要表现为腹痛、呕吐、腹胀、停止排气排便，且X线检查可见气液平面。